细粉是指
A. 能全部通过二号筛，但混有能通过四号筛不超过40%的粉末
B. 能全部通过四号筛，但混有能通过五号筛不超过60%的粉末
C. 能全部通过五号筛，并能通过六号筛不少于95%的粉末
D. 能全部通过六号筛，并能通过七号筛不少于95%的粉末
E. 能全部通过八号筛，并能通过九号筛不少于95%的粉末

正确答案：C。能全部通过五号筛，并能通过六号筛不少于95%的粉末

解析：本题考查的是散剂的质量要求。细粉是指能全部通过五号筛，并能通过六号筛不少于95%的粉末（C对）。按照《中国药典》要求，最粗粉指能全部通过一号筛，但混有能通过三号筛不超过20%的粉末；粗粉指能全部通过二号筛，但混有能通过四号筛不超过40%的粉末（A错）；中粉指能全部通过四号筛，但混有能通过五号筛不超过60%的粉末（B错）；细粉指能全部通过五号筛，并含能通过六号筛不少于95%的粉末；最细粉指能全部通过六号筛，并含能通过七号筛不少于95%的粉末（D错）；极细粉指能全部通过八号筛，并含能通过九号筛不少于95%的粉末（E错）。